女性，5岁。诉牙齿自动脱落、牙龈出血。口腔异味明显。检查：口内余留乳牙松动Ⅰ°～Ⅱ°，牙周袋深。X线片示：牙槽骨普遍吸收，牙根细而尖，患儿手掌和足底过度角化、皲裂等，初步诊断为
A. 青春前期牙周炎
B. 掌跖角化-牙周破坏综合征
C. Down综合征
D. 糖尿病引起的牙周炎
E. 顽固性牙周炎

正确答案：B。掌跖角化-牙周破坏综合征

解析：本题考查掌跖角化-牙周破坏综合征的临床表现。患儿牙齿松动且自动脱落，牙龈出血，有深牙周袋，有明显的口腔异味，牙槽骨普遍吸收，牙根细而尖表明牙骨质发育不佳，手掌和足底过度角化、皲裂，患者的典型临床表现符合掌跖角化-牙周破坏综合征（B对）的病变特点。青春前期牙周炎（A错）是侵袭乳牙的不常见的牙周疾病，常在乳牙萌出后很短时期内发生，多见于4岁左右的儿童，普遍的急性增生性龈炎和牙槽骨快速破坏为其特点，可发生乳牙松动脱落，但无手掌和足底过度角化、皲裂的表现。Down综合征（C错）是一种由染色体异常所引起的先天性疾病，患者全口牙齿均有深牙周袋及炎症，下颌前牙较重，有时可伴坏死性龈炎。糖尿病引起的牙周炎（D错）牙周组织的炎症较重，龈缘红肿呈肉芽状增生，易出血和发生牙周脓肿，牙槽骨破坏迅速，导致深牙周袋和牙松动。顽固性牙周炎（E错）是指有些牙周炎患者对常规牙周治疗包括洁治、龈下刮治、牙周手术和抗生素治疗反应很差，或在经过彻底治疗后的短期内疾病继续加重而原因不明，无手掌和足底过度角化、皲裂的现象。